男，45岁。间断上腹部不适1年。经检查诊断为“慢性胃炎并幽门螺旋杆菌感染”。医生建议其服用奥美拉唑20mg阿莫西林1.0g、克拉霉素0.5g，均每日两次。上述药物的服用疗程应为
A. 1～2天
B. 3～5天
C. 7～14天
D. 15～20天
E. ＞30天

正确答案：C。7～14天

解析：该患者诊断为慢性胃炎合并幽门螺旋杆菌感染，医生建议其服用奥美拉唑（PPI）、阿莫西林（抗生素）以及克拉霉素（抗生素），即三联疗法（一种PPI+2种抗生素），疗程一般为7～14天（C对）。